血压骤然升高，剧烈头痛，呕吐，意识模糊，抽搐，属于
A. 高血压病1级
B. 高血压病2级
C. 高血压病3级
D. 高血压危象
E. 高血压脑病

正确答案：D。高血压危象

解析：患者血压骤然升高所导致剧烈头痛，呕吐，意识模糊，抽搐等症状，最有可能的诊断为高血压危象（D对）。高血压危象是指血压突然升高（一般超过180/120mmHg），伴有进行性心、脑、肾等重要靶器官功能不全的表现，如眩晕、头痛、视物模糊、心悸、潮红或者苍白、无力等。高血压脑病(E错）主要表现为脑部症状，主要表现为脑水肿，从而引起神志、意识的改变（E错）。高血压病1级（A错）收缩压140～159mmHg和（或）舒张压90～99mmHg。高血压病2级（B错）收缩压160～179mmHg和（或）舒张压100～109mmHg。高血压病3级（C错）收缩压≥180mmHg和（或）舒张压≥110mmHg。